女婴，8个月。发热、呕吐、腹泻、少尿2天。查体：哭无泪，眼窝、前囟明显凹陷。皮肤弹性较差，呈花纹状。心音低钝，四肢末梢凉。实验室检查：粪常规未见红细胞、白细胞，可见脂肪滴。血清钠135mmol/L。患儿的脱水程度属于
A. 中度等渗性脱水
B. 中度高渗性脱水
C. 重度低渗性脱水
D. 重度等渗性脱水
E. 中度低渗性脱水

正确答案：D。重度等渗性脱水

解析：患儿，已经腹泻、呕吐2天，并有哭无泪、眼窝和前囟明显凹陷、皮肤弹性差，呈花纹状、四肢末梢凉临床症状，说明该患儿属于重度脱水。体检得血钠135mmol/L在低于130～150mmol/L的范围内，可诊断为等渗性脱水。综上所述该患儿为重度等渗性脱水（D对）。